可用于马钱子中毒解救的药是
A. 二巯基丙醇类
B. 尼可刹米
C. 肾上腺素
D. 苯巴比妥钠
E. 阿托品

正确答案：D。苯巴比妥钠

解析：本题考查的是马钱子中毒的解救方法。可用于马钱子中毒解救的药是苯巴比妥钠（D对）。马钱子及含马钱子的中成药的中毒解救：1.患者需保持安静，避免声音、光线刺激（因外界刺激可引发惊厥痉挛），吸氧。2.清除毒物，洗胃、导泻。较大量的静脉输液，以加快排泄。3.对症治疗，痉挛时可静脉注射苯巴比妥钠0.2～0.3g。4.肉桂煎汤或甘草煎汤饮服。二巯基丙醇类（A错）可用于雄黄及含雄黄的中成药的中毒解救。雄黄及含雄黄的中成药的中毒解救：1.清除毒物，如催吐、洗胃、导泻、输液，服用牛奶、蛋清、豆浆、药用炭等吸附毒物，保护黏膜，必要时可应用二巯基丙醇类。2.纠正水液代谢和电解质紊乱，抗休克、肾透析等对症治疗。3.甘草、绿豆煎汤饮用，也可用中医对症治疗。尼可刹米（B错）可用于香加皮的不良反应救治。香加皮的不良反应救治：①甘草15g、绿豆30g，水煎服。②心律失常时，干姜6g、附子12g、甘草6g、葱白2节，煎服。每2～4小时服一次。禁用钙剂、拟肾上腺素药。③心跳过缓时注射阿托品0.5～1mg，必要时重复注射。④呼吸困难时，可用山梗菜碱、尼可刹米等。肾上腺素（C错）可用于蓖麻子的不良反应救治。蓖麻子的不良反应救治：（1）用1：4000高锰酸钾或2%～3%药用炭洗胃，口服5mg酒石酸锑钾催吐，用50%硫酸镁或硫酸钠导泻。而后口服牛奶、蛋清、冷米汤等保护胃黏膜。（2）对症治疗：①如有惊厥，可给予镇静剂苯巴比妥钠或水合氯醛等。②剧烈呕吐、腹泻时，可静脉滴注葡萄糖氯化钠注射液和乳酸钠注射液，并给予止吐剂，心力衰竭时用强心剂。③出现溶血时，可用激素，并给予补血药。有心律失常时，可给利多卡因抗心律失常。④如有条件，可皮下注射抗蓖麻毒血清并输血。出现过敏休克时，皮下注射肾上腺素，静脉输入10%葡萄糖注射液、多巴胺、地塞米松、维生素C。然后用5%葡萄糖注射液加氢化可的松、间羟胺、山梗菜碱、氨茶碱抢救。（3）中药治疗：①仙人掌30g，捣烂如泥，加适量肥皂水灌肠。②甘草30g、沙参15g、金银花15g、黄连9g、云茯苓3g，水煎，早晚各服1次。③防风30g、甘草15g，水煎至200ml，顿服。阿托品（E错）可用于乌头类药物的中毒解救。乌头类药物的中毒解救：1.清除毒物，在无惊厥及严重心律失常情况下，反复催吐、洗胃。2.肌内注射阿托品0.5～1.0mg，根据病情可注射数次。如未见症状改善或出现阿托品毒性反应，可改用利多卡因静脉注射或静脉滴注。3.对呼吸衰竭、昏迷及休克等垂危患者，酌情对症治疗。4.绿豆、甘草、生姜、蜂蜜等煎汤内服。